男孩，3岁，水肿一周。尿中有泡沫，尿量减少。查体：T36.7℃，P120次/分，BP90/60mmHg。眼睑水肿，双下肢凹陷性水肿，双肺呼吸音粗，未闻及啰音，心前区未闻及杂音，腹膨隆，移动性浊音（＋）。尿常规：尿蛋白（+++）。尿沉渣镜检：RBC0～3/HP，WBC0～3/HP。血清白蛋白20g/L，胆固醇8.7mmol/L。最可能的诊断是
A. 急进性肾炎
B. 单纯型肾病综合征
C. 急性肾小球肾炎
D. 泌尿道感染
E. 肾炎型肾病综合征

正确答案：B。单纯型肾病综合征

解析：男性幼儿患者，水肿一周。尿中有泡沫，尿量减少。眼睑水肿，双下肢凹陷性水肿。查体：T36.7℃（正常值36～37℃），BP90/60mmHg（正常值90～120/60～80mmHg）。尿常规：尿蛋白（+++）（＞3.5g/d）。血清白蛋白20g/L（＜30g/L），胆固醇8.7mmol/L（正常值成人2.9～6.0mmol/L，儿童3.1～5.2mmol/L）。尿沉渣镜检：RBC0～3/HP（正常值＜3/HP）。综合患者的症状、体征和辅助检查，最可能的诊断是单纯型肾病综合征（B对）。急进性肾炎（A错）表现为严重的血尿、突出的少尿及进行性肾衰竭。急性肾小球肾炎（C错）表现为血尿、蛋白尿、水肿和高血压。泌尿道感染（D错）体温多升高。肾炎型肾病综合征（E错）表现为离心尿检查红细胞≥10个/HP、反复或持续高血压、肾功能不全、持续低补体血症。